药师工作失误、未能很好履行职责造成不合理用药，主要表现在
A. 疾病诊断有误
B. 审查处方不严
C. 调剂配发错误
D. 用药指导不力
E. 给药操作失当

正确答案：B、C、D。审查处方不严；调剂配发错误；用药指导不力